决定红细胞血型的物质是
A. 红细胞膜特异凝集原
B. 红细胞膜特异受体
C. 红细胞膜特异凝集素
D. 血浆特异性凝集原
E. 血浆特异性凝集素

正确答案：A。红细胞膜特异凝集原

解析：血型通常是指红细胞膜上特异性抗原的类型，因红细胞膜上特异性抗原在凝集反应中被称为凝集原，因此决定红细胞血型的物质是红细胞膜特异凝集原（A对）；能与红细胞膜上的凝集原起反应的特异性抗体则称为凝集素（CE错），主要存在于血浆中。